用于评价肝功能不全严重程度的是
A. 数字评分法
B. CTP评分标准
C. Cochrane证据分级
D. APACHE评分系统
E. Beers标准

正确答案：B。CTP评分标准

解析：本题考查评价肝功能不全严重程度的标准。用于评价肝功能不全严重程度的是CTP评分标准（B对）。临床可以用CTP评分作为肝功能不全分级的评估系统。数字评分法（A错）用于评估癌痛患者疼痛程度。Cochrane证据分级（C错）为循证医学的证据分级。Beers标准（E错）由美国老年医学会建立，用于判断老年患者潜在不适当用药。